全口义齿就位困难的原因有
A. 倒凹过大
B. 垂直距离过高
C. 基托边缘过长
D. 组织面有小瘤
E. 以上都不是

正确答案：A。倒凹过大

解析：本题考查全口义齿就位困难的原因。基托局部倒凹过大（A对），则不能与牙槽嵴黏膜密合，就位困难。垂直距离过高（B错）即息止颌间隙过小，表现为面下1/3距离增大、上下唇张开、肌肉张力增大、说话和进食时义齿容易脱位；基托边缘过长（C错）会产生压痛，影像周围软组织的活动导致固位不良；组织面有小瘤（D错）也会产生压痛，这些都不会影响就位。